港口、机场、铁路疾病预防控制机构以及国境卫生检疫机关发现下列哪种传染病时，应当按照国家有关规定立即向国境口岸所在地的疾病预防控制机构或者所在地县级以上地方人民政府卫生行政部门报告并互相通报
A. 黑热病
B. 流行性脑脊髓膜炎
C. 狂犬病
D. 流行性感冒
E. 霍乱

正确答案：E。霍乱